广场恐怖的共同特征为
A. 怕接触人
B. 怕无力帮助
C. 怕空荡怕风
D. 怕无法迅速离开
E. 怕被人迫害

正确答案：D。怕无法迅速离开

解析：广场恐惧症主要表现为患者害怕离家或独处，害怕处于被困、窘迫或无助的环境，患者在这些自认为难以逃离（D对）、无法获助的环境中恐惧不安。